治疗急性心肌梗死引起的室性心动过速的首选药是
A. 奎尼丁
B. 普鲁卡因胺
C. 普萘洛尔
D. 利多卡因
E. 维拉帕米

正确答案：D。利多卡因